ACEI的作用机制不包括
A. 减少血液缓激肽水平
B. 减少血液血管紧张素Ⅱ水平
C. 减少血液儿茶酚胺水平
D. 减少血液加压素水平
E. 增加细胞内cAMP水平

正确答案：A。减少血液缓激肽水平